为了维持水出入平衡每天需要摄入水的量（日需要量）是
A. 1500ml
B. 2000ml
C. 2500ml
D. 1500~2000ml
E. 3000ml

正确答案：D。1500~2000ml

解析：正常成人每天需水1500 -2000ml（D对）以维持水分出入量的平衡，即日需要量。